流行性脑脊髓膜炎的典型的病理变化为
A. 神经细胞变性坏死
B. 淋巴细胞血管周袖套状浸润
C. 蛛网膜下腔脓性渗出物聚集
D. 噬神经细胞现象
E. 脑软化灶形成

正确答案：C。蛛网膜下腔脓性渗出物聚集

解析：流行性脑脊髓膜炎是由脑膜炎双球菌感染引起的脑脊髓膜的急性化脓性炎症，其典型的病理变化为蛛网膜下腔脓性渗出物聚集（C对）。神经细胞变性坏死（A错）、淋巴细胞血管周袖套状浸润（B错）、噬神经细胞现象（D错）、脑软化灶形成（E错）为流行性乙型脑炎的病理变化（P322）。